痰饮兼冲气上逆时治用
A. 苓桂味甘汤
B. 桂枝五味甘草汤
C. 桂枝加桂汤
D. 苓甘五味姜辛汤
E. 苓桂术甘汤

正确答案：A。苓桂味甘汤

解析：咳逆不得卧，经服用小青龙汤以后，吐出很多痰而口干燥，为寒饮将去之象。由于其人下焦真阳素虚，饮邪上盛，是一种下虚上实之证，所以寸脉见沉，尺脉微弱，而且四肢厥逆。虽然寒饮在上焦，但不能单用温散之剂，必须兼顾下焦，始为两全之策。服小青龙汤后，寒饮固然得以暂解，虚阳亦随之上越，冲气反而上逆，出现种种变证。如气从小腹上冲、直至胸咽，四肢麻木，其面戴阳，翕热如醉状等。冲脉为病是时发时止的，有时又能复还于下焦，在下则小便困难，在上则时作昏冒。当此之时，宜急予敛气平冲，用桂苓五味甘草汤（A对）。方中桂枝、甘草辛甘化阳以平冲气，配茯苓引逆气下行，五味子收敛耗散之气，使虚阳不致上浮。